药品批发企业的药品验收记录应保存
A. 1年
B. 3年
C. 5年
D. 超过药品有效期1年，但不得少于3年
E. 超过药品有效期1年，但不得少于4年

正确答案：C。5年